甲状腺峡平对
A. 第2-4气管软骨
B. 第8胸椎
C. 第4胸椎下缘
D. 第l2胸椎
E. 第l腰椎

正确答案：A。第2-4气管软骨

解析：甲状腺峡平对第2-4气管软骨（A对）。